观察到损害作用的最低剂量是
A. 引起畸形的最低剂量
B. 引起DNA损伤的最低剂量
C. 引起某项检测指标出现异常的最低剂量
D. 引起染色体畸变的最低剂量
E. 引起免疫功能减低的最低剂量

正确答案：C。引起某项检测指标出现异常的最低剂量